患者，40岁。因反复机会感染入院，检查发现患者伴发卡波西肉瘤。诊断应首先考虑
A. 先天性胸腺发育不全
B. 腺苷脱氨酶缺乏症
C. 梅毒
D. 艾滋病
E. 选择性IgA缺乏症

正确答案：D。艾滋病

解析：患者因反复机会感染入院，伴发卡波西肉瘤，诊断应首先考虑艾滋病（D对）。艾滋病全称为获得性免疫缺陷综合征（AIDS）临床常表现为原因不明的发热、淋巴结肿大、全身皮疹、慢性腹泻等，最终并发多种机会性感染或恶性肿瘤，卡波西肉瘤为目前公认的恶性肿瘤。先天性胸腺发育不全（A错）常见于小儿，表现为手足搐搦，伴有特殊面容，如眼眶距离增宽，耳廓位置低且有切迹，上唇正中纵沟短颌小和鼻裂，常存在大血管异常，如法洛四联症和主动脉弓右位，与本例患者不符。腺苷脱氨酶缺乏症（B错）常见于小儿，临床表现多为部位反复而严重的细菌、真菌、病毒及原虫的感染，发生严重腹泻、肺炎、中耳炎、脑膜炎等，部分患儿可表现中枢神经系统症状，如震颤、舞蹈样动作及神经性耳聋等；本例患者与之不符。梅毒（C错）有典型的硬下疳、近卫淋巴结肿大、梅毒疹、皮肤黏膜损害等特异性表现，本例患者与之不符。选择性IgA缺乏症（E错）多数无症状，部分有程度不同的鼻窦与呼吸道感染；有些病人有慢性腹泻、吸收不良综合征等；本例患者与之不符。